传染源向其周围传播病原体所能涉及范围称
A. 疫区
B. 疫点
C. 传染地
D. 疫源地
E. 污染区

正确答案：D。疫源地

解析：本题考查疫源地的概念。疫源地（D对ABCE错）是指传染源及其排出的病原体向周围播散所能波及的范围。